下列辅料中不可作为片剂润滑剂的是
A. 微粉硅胶
B. 糖粉
C. 月桂醇硫酸镁
D. 滑石粉
E. 氢化植物油

正确答案：B。糖粉

解析：本题考查片剂的常用辅料。糖粉（B错，为本题正确答案）常用作片剂的稀释剂，不作为润滑剂使用。片剂常用的润滑剂（广义）有硬脂酸镁（MS）、微粉硅胶（A对）、滑石粉（D对）、氢化植物油（E对）、聚乙二醇类、十二烷基硫酸钠（月桂醇硫酸钠）（C对）等。